双层腹膜结构
A. 子宫圆韧带
B. 子宫主韧带
C. 骶子宫韧带
D. 卵巢悬韧带
E. 子宫阔韧带

正确答案：E。子宫阔韧带

解析：子宫圆韧（A错）、子宫主韧带（B错）、子宫骶韧带（C错）、卵巢悬韧带（D错）均由平滑肌和结缔组织构成。子宫阔韧带是双层腹膜结构（E对）。